丹毒风热毒蕴型的主方
A. 普济消毒饮
B. 阳和汤
C. 托里消毒散
D. 五神汤
E. 犀角地黄汤

正确答案：A。普济消毒饮

解析：普济消毒饮适用于丹毒风热独盛证（A对）。阳和汤适用于阴证疮疡（B错）。托里消毒散适用于正气不足无法托毒外出（C错）。五神汤适用于丹毒湿热毒蕴证（D错）。犀角地黄汤适用于胎火蕴毒证（E错）。